以下关于腹部闭合性损伤导致肠损伤的描述，错误的是
A. 小肠损伤后腹腔穿刺常呈阳性
B. 小肠损伤后常易出现腹膜刺激症
C. 肠损伤后均有膈下游离气体
D. 小肠损伤多于结肠损伤
E. 结肠损伤后的感染表现一般较晚但严重

正确答案：C。肠损伤后均有膈下游离气体

解析：小肠占据着中、下腹的大部分空间，所以小肠损伤多于结肠损伤（D对）。小肠损伤后肠液漏入腹腔后腹腔穿刺常呈阳性（A对），易出现腹膜刺激症（B对）。小肠损伤导致穿孔仅少数病人有气腹，所以不是所有患者都会出现膈下游离气体（C错，为本题正确答案）。结肠内容物液体成分少而细菌含量多，故腹膜炎出现得较晚，但较严重（E对）。